不正确的是
A. 上界为腭，下界为口腔底
B. 借上、下牙弓分为口腔前庭和固有口腔两部分
C. 上、下牙弓咬合后，口腔前庭与固有口腔互不相通
D. 向前借口裂与外界相通
E. 向后借咽峡与口咽部相通

正确答案：C。上、下牙弓咬合后，口腔前庭与固有口腔互不相通

解析：口腔上界为腭，下界为口腔底(A对)，借上下牙弓分为口腔前庭和固有口腔(B对)，当上下牙弓咬合时，口腔前庭和固有口腔可通过第三磨牙后方间隙相通(C错，为本题正确答案)，口腔向前借口裂与外界相通(D对)，向后经咽峡与口咽相通(E对)。